临床上最常见的人炭疽为
A. 皮肤炭疽
B. 肺炭疽
C. 肠炭疽
D. 炭疽性败血症
E. 炭疽性脑膜炎

正确答案：A。皮肤炭疽

解析：人类主要通过接触病畜及其皮毛等引起皮肤炭疽；食入未煮熟的病畜肉类，病畜奶或被污染的食物，引起肠炭疽；吸入含有大量炭疽菌芽胞的尘埃，可发生肺炭疽。掌握“动物源性细菌”知识点。